乙琥胺常见副作用是
A. 胃肠道反应
B. 中枢神经系统症状
C. 呼吸急促
D. 血液系统
E. 心率加快

正确答案：A。胃肠道反应